阿托品不能引起
A. 心率加快
B. 眼内压下降
C. 口干
D. 视物模糊
E. 扩瞳

正确答案：B。眼内压下降